列入国家二级重点保护野生药材物种名录的药材是
A. 豹骨
B. 麝香
C. 龙胆
D. 蝮蛇
E. 人工牛黄

正确答案：B。麝香

解析：本题考查二级保护野生药材物种。列入国家二级重点保护野生药材物种名录的药材是麝香（B对）。二级保护野生药材物种系指分布区域缩小，资源处于衰竭状态的重要野生药材物种。属于二级保护药材的有：鹿茸（马鹿）、麝香（3个品种）、熊胆（2个品种）、穿山甲、蟾酥（2个品种）、蛤蟆油、金钱白花蛇、乌鞘蛇、蕲蛇、蛤蚧、甘草（3个品种）、黄连（3个品种）、人参、杜仲、厚朴（2个品种）、黄柏（2个品种）、血竭。豹骨（A错）为国家一级保护野生药材物种。龙胆（C错）为国家三级保护野生药材物种。蝮蛇（D错）、人工牛黄（E错）未列入国家重点保护野生药材名录。